根据《中华人民共和国药品管理法》，药品监督管理部门批准开办药品经营企业，除应具备规定的开办条件外，还应遵循的原则是
A. 市场调节、方便群众购药
B. 合理布局、保证质量
C. 合理布局、方便群众购药
D. 品种齐全、诚实信用
E. 公平合理、救死扶伤

正确答案：C。合理布局、方便群众购药